目前用于判断慢性阻塞性肺疾病严重程度的肺功能指标是
A. FEV₁占预计值百分比
B. FVC占预计值百分比
C. RV/TLC（残总比）
D. MVV占预计值百分比
E. FEV₁/FVC（一秒率）

正确答案：A。FEV₁占预计值百分比

解析：慢性阻塞性肺疾病患者RV（残气量）、TLC（肺总量）均增高，因此RV/TLC（C错）并不能良好的反应其肺功能的状况。MVV（最大通气量）占预计值百分比（D错）是肺功能的检查之一，若实测值占预测值80～100%，为基本正常，60～70%为稍减退，40～50%为显著减退，但由于MVV测量费力，因此其并不用作判断慢性阻塞性肺疾病严重程度的常用指标。FVC（即用力肺活量）占预计值百分比（B错）也可作为判定肺功能的指标，但是慢阻肺的早期，FVC也可以表现正常，临床上并不常用。目前主要使用FEV₁（第一秒用力呼吸容积）占预计值百分比（A对）来判断慢性阻塞性肺疾病严重程度。FEV₁/FVC（一秒率）（E错）＜0.70是诊断慢性阻塞性肺疾病的必要条件。